用于脑水肿最安全有效的药物是
A. 山梨醇
B. 高渗葡萄糖
C. 呋塞米
D. 甘露醇
E. 氢氯噻嗪

正确答案：D。甘露醇

解析：甘露醇是目前降低颅内压安全有效的首选药。该药不易进入脑组织或眼前房等有屏障的特殊组织，静脉滴入后对这些组织特别容易发生脱水作用，适用于多种原因如脑瘤、颅脑外伤或组织缺氧等引起的脑水肿，以及青光眼病人手术前降低眼内压（D对）。